女性，36岁，因半年来右上后牙龈发现小包，曾肿痛2次，流出少许脓液。要求诊治，必要的一项检查是
A. 探诊
B. 叩诊
C. 扪诊
D. 牙齿松动度
E. X线片检查

正确答案：E。X线片检查

解析：本题考查慢性根尖周炎。患者牙龈小包反复肿痛已半年，流出少许脓液。提示患牙最可能为慢性根尖周脓肿，确诊该病的检查只有X线片检查（E对）。